《中国药典》中，厚朴质量控制成分的结构类型是
A. 黄酮
B. 香豆素
C. 蒽醌
D. 二萜
E. 木质素

正确答案：E。木质素

解析：本题考查中药的主要化学成分。《中国药典》中，厚朴质量控制成分的结构类型是木质素（E对）。厚朴中主要化学成分为木脂素类化合物，包括厚朴酚以及和厚朴酚等，《中国药典》采用高效液相色谱法测定厚朴药材中厚朴酚与和厚朴酚的含量。槐米含有芦丁、槲皮素、皂苷、白桦脂醇、槐二醇、槐米甲素、槐米乙素、槐米丙素和黏液质等。《中国药典》以总黄酮（A错）和芦丁为指标成分对槐米或槐花进行含量测定。前胡主要化学成分为多种类型的香豆素（B错）及其糖苷、三萜糖苷及甾体糖苷、挥发油等。一般以香豆素类成分作为前胡定量质量控制的指标。从大黄中分离得到蒽醌、二蒽酮、芪、苯丁酮、单宁、萘色酮等不同种类的80多种化合物，大体上可分为蒽醌类、多糖类与鞣质类。《中国药典》以总蒽醌（C错）和游离蒽醌为指标成分。穿心莲叶中含有多种二萜内酯（D错）及二萜内酯苷类成分，如穿心莲内酯、新穿心莲内酯、14-去氧穿心莲内酯、脱水穿心莲内酯等。其中穿心莲内酯含量最高，为其主要活性成分。《中国药典》以穿心莲内酯、新穿心莲内酯，14-去氧穿心莲内酯、脱水穿心莲内酯为指标成分对穿心莲进行含量测定。